初产妇，28岁。10天前在家中经阴道分娩，产后血性恶露持续时间长，无异味。突然出血增多1天，无寒战、高热。查体：子宫如妊娠3个月大，质软，压痛不明显，宫口松，能容2指。其阴道流血最可能的原因是
A. 子宫脱垂
B. 子宫内膜炎
C. 子宫颈裂伤
D. 蜕膜残留
E. 胎盘、胎膜残留

正确答案：E。胎盘、胎膜残留

解析：患者为产褥妇，阴道分娩10天（＞24小时，胎盘、胎膜残留为阴道分娩最常见的原因，多发生于产后10日左右），产后血性恶露持续时间长，无异味。突然出血增多1天，无寒战、高热（临床表现为血性恶露持续时间延长，以后反复出血或突然大量流血）。查体：子宫如妊娠3个月大，质软，压痛不明显，宫口松，能容2指（检查可发现子宫复旧不全，宫口松弛，有时可见残留组织）。考虑为晚期产后出血，其阴道流血最可能的原因是胎盘、胎膜残留（E对）。子宫脱垂（P287）（A错）轻症患者一般无不适，重症常有阴道前后壁膨出、阴道黏膜增厚角化，伴有腰骶部酸痛或下坠感，并有排尿困难、便秘，甚至尿失禁，一般不会引起阴道流血。子宫内膜炎（P261）（B错）的主要临床表现为发热，下腹痛，阴道内有大量脓性分泌物且有臭味。子宫颈裂伤（P212）（C错）为软产道裂伤的一种，导致产后出血，而不是晚期产后出血，主要临床表现为取出的胎盘完整，但有持续性阴道出血（鲜红色，伴有血块）。蜕膜残留（D错）常见临床表现为子宫复旧不全，易继发子宫内膜炎。而该患者无发热，无异味恶露，无寒战、高热，查体子宫质软，压痛不明显，说明无继发性子宫内膜炎。蜕膜残留与胎盘、胎膜残留不易鉴别，前者宫颈刮出物病理检查见坏死蜕膜、纤维素、玻璃样变的蜕膜细胞及红细胞，但不见绒毛。